患者，女，27岁。G₂P₁，停经60天，阴道流血10余天。尿妊娠试验阳性。如为葡萄胎，治疗后应该避孕的时间为
A. 1~2年
B. 六个月
C. 2年～3年
D. 3年～4年
E. 4年～5年

正确答案：B。六个月

解析：根据八版妇产科学：葡萄胎患者随访期间应可靠避孕1年，对hCG下降缓慢者，应延长避孕时间，所以治疗后应该避孕的时间为1年～2年。根据九版妇产科学：葡萄胎患者随访期间应可靠避孕。由于葡萄胎后滋养细胞肿瘤极少发生在hCG自然降至正常以后，所以避孕时间为六个月（B对）。